下列有关氯己定作用机制的论述中，错误的是
A. 减少唾液中能吸附到牙面上的细菌数
B. 氯己定与唾液酸性糖蛋白的酸性基团结合，使唾液糖蛋白对牙面的吸附能力增强
C. 封闭唾液糖蛋白的酸性基团，抑制获得性膜和菌斑的形成
D. 氯己定与牙面釉质结合，阻碍了唾液细菌对牙面的吸附
E. 氯己定取代Ca2+与唾液中凝集细菌的酸性凝集因子作用，抑制了细菌吸附

正确答案：B。氯己定与唾液酸性糖蛋白的酸性基团结合，使唾液糖蛋白对牙面的吸附能力增强

解析：氯己定与唾液酸性糖蛋白的酸性基团结合，从而封闭唾液糖蛋白的酸性基团，使唾液糖蛋白对牙面的吸附能力减弱，抑制获得性膜和菌斑的形成。掌握“菌斑控制及提高宿主抵抗力”知识点。